某中学生，15岁。经骨髓穿刺检查诊断为“急性淋巴细胞白血病”，给以常规治疗，症状无缓解。医生告诉家长，此病目前尚无理想的治疗方法，医院正在尝试使用一种疗效不肯定、有一定风险的药物，其家长表示愿意做这种试验性治疗，但没有履行书面承诺手续，治疗二天后，病人病重，抢救无效，死亡。此后，家属否认曾同意这种治疗方案，称是“拿病人做试验”，要追究医生责任，于是造成医疗纠纷。就本案分析，医生做出选择的伦理依据是
A. 研究目的是正确的
B. 符合知情同意的原则
C. 符合受试者利益的原则
D. 治疗期间，医生是积极负责的
E. 以上各点都符合临床医学研究原则，没有错误

正确答案：E。以上各点都符合临床医学研究原则，没有错误

解析：实行知情同意是一个在医生与病人（有时包括病人家属）之间相互交流、协商，有时包括耐心说服的过程。题目中说明了问题“医生做出选择的伦理依据”从医生的角度讲已经做到了知情同意的原则，没有履行书面承诺属于问责的部分，与医生的出发点无关。掌握“医患关系伦理”知识点。